1型糖尿病患者的胰腺不会出现的病理是
A. 胰岛细胞增生
B. 胰岛细胞坏死
C. 间质钙化
D. 间质纤维化
E. 胰岛细胞空泡变性

正确答案：A。胰岛细胞增生

解析：1型糖尿病患者的胰岛B细胞严重受损，胰岛细胞数目明显减少（A错，为本题正确答案），可出现胰岛细胞空泡变性（E对）、胰岛细胞坏死（B对）消失、间质纤维化（D对）和钙化等。